视神经由下列哪种细胞突起构成
A. 视锥细胞和视杆细胞
B. 视锥细胞
C. 视杆细胞
D. 双极细胞
E. 神经节细胞

正确答案：E。神经节细胞

解析：节细胞的轴突向构成视神经，即视神经由神经节细胞突起构成（E对）。视锥细胞和视杆细胞（ABC错）属于感光细胞，不参与视神经的构成。双极细胞（D错）传导来自感光细胞的神经冲动，也不参与视神经的构成。